关于药品质量标准中检查项的说法，错误的是
A. 检查项包括反映药品安全性与有效性的试验方法和限度、均一性与纯度等制备工艺要求
B. 除另有规定外，凡规定检查溶出度或释放度的片剂，不再检查崩解时限
C. 单剂标示量小于50mg或主药含量小于单剂重量50%的片剂，应检查含量均匀度
D. 凡规定检查含量均匀度的制剂，不再检查重（装）量差异
E. 崩解时限、溶出度与释放度、含量均匀度检查法属于特性检查法

正确答案：C。单剂标示量小于50mg或主药含量小于单剂重量50%的片剂，应检查含量均匀度

解析：本题考查药品质量标准中检查项。关于药品质量标准中检查项的说法，错误的是单剂标示量小于50mg或主药含量小于单剂重量50%的片剂，应检查含量均匀度（C错，为本题正确答案）。除另有规定外，片剂、硬胶囊剂、颗粒剂或散剂等，每一个单剂标示量小于25mg或主药含量小于每一个单剂重量25%者；药物间或药物与辅料间采用混粉工艺制成的注射用无菌粉末；内充非均相溶液的软胶囊；单剂量包装的口服混悬液、透皮贴剂和栓剂等品种项下规定含量均匀度应符合要求的制剂，均应检查含量均匀度。《中国药典》检查项下包括反映药品的安全性与有效性的试验方法和限度、均一性与纯度等制备工艺要求（A对）等内容。崩解时限、溶出度与释放度、含量均匀度检查法属于特性检查法（E对）。崩解时限检查法系用于检查口服固体制剂在规定条件下的崩解情况。崩解系指口服固体制剂在规定条件下全部崩解溶散或成碎粒，除不溶性包衣材料或破碎的胶囊壳外，应全部通过筛网。如有少量不能通过筛网，但已软化或轻质上漂且无硬心者，可作符合规定论。除另有规定外，凡规定检查溶出度、释放度或分散均匀性的制剂，不再进行崩解时限检查（B对）。凡规定检查含量均匀度的制剂，不再检查重（装）量差异（D对）。